患者，女，78岁。慢性肺源性心脏病史15年。近日受凉后咳喘加重，气急不能平卧，神志恍惚，谵语，抽搐，烦躁不安，咯痰不爽，舌淡紫，苔白腻，脉细滑数。其中医治法是
A. 清肺化痰，降逆平喘
B. 涤痰开窍，熄风止痉
C. 温肾健脾，化饮利水
D. 补肺纳肾，降气平喘
E. 健脾益肺，化痰降气

正确答案：B。涤痰开窍，熄风止痉

解析：患者慢性肺源性心脏病史15年，近日受凉后风寒之邪引动内伏之痰则咳喘加重，气急不能平卧；痰蒙神窍故见神志恍惚，谵语，烦躁不安；舌淡紫，苔白腻，脉细滑数均为痰蒙神窍证的特点，可诊断为痰蒙神窍证，治法为涤痰开窍，熄风止痉（B对）。清肺化痰，降逆平喘（A错）用于治疗痰热郁肺证。温肾健脾，化饮利水（C错）用于治疗脾肾阳虚，水饮上犯证。补肺纳肾，降气平喘（D错）用于治疗肺肾气虚证。健脾益肺，化痰降气（E错）用于治疗痰浊壅肺证。